下列关于t分布特征的叙述，错误的是
A. t分布为单峰分布
B. t分布曲线是一簇曲线
C. 以0为中心，左右对称
D. 自由度越大，t分布曲线的峰部越低，尾部越高
E. 自由度为无穷大时，t分布就是标准正态分布

正确答案：D。自由度越大，t分布曲线的峰部越低，尾部越高